成年男性。三个月来双下肢无力麻木逐渐加重，背后疼痛且咳嗽时加剧。查体：左半侧T8以下痛温觉消失，右下肢肌力3级，腱反射亢进，Babinski征阳性，右下肢足趾振动觉、位置觉消失。该脊髓损害为
A. 脊髓后角损害
B. 脊髄横贯性损害
C. Brown-Seguard综合征
D. 脊神经根损害
E. 脊髓后索和侧索联合损害

正确答案：C。Brown-Seguard综合征

解析：成年男性患者，三月来出现脊髓损害症状、明显神经根痛、左半侧浅感觉消失、右下肢上运动神经元瘫痪、深感觉消失。结合病史诊断为慢性脊髓受压所致的神经根痛及右侧T5-6水平Brown-Seguard综合征（脊髓半切综合征）（C对）。脊髓横贯性损害（B错）表现为损害平面以下各种感觉缺失、上运动神经元瘫痪及括约肌障碍等（P22）。脊髓后角损害（A错）表现为患侧痛温觉缺失、触觉保留的分离性感觉障碍（P22）。脊神经根损害（D错）表现损伤相应节段的下运动神经元性瘫痪（损伤脊神经前根）和（或）深浅感觉障碍（损伤脊神经后根）。脊髓后索和侧索联合损害（E错）分别表现为振动觉、位置觉障碍、感觉性共济失调和对侧肢体病变水平以下上运动神经元性瘫痪和痛温觉障碍（P22）。